从乳浊液中除去分散相挥发性溶剂以制备微囊的方法是
A. 复凝聚法
B. 喷雾冻凝法
C. 单凝聚法
D. 液中干燥法
E. 多孔离心法

正确答案：D。液中干燥法

解析：本题考查液中干燥法的定义。液中干燥法（D对）是从乳浊液中除去分散相挥发性溶剂制备微囊（球）的方法。